上消化道出血表现为呕血或黑便，主要取决于
A. 出血的速度和量
B. 出血部位的高低
C. 病变的性质
D. 凝血机制
E. 胃肠蠕动情况

正确答案：A。出血的速度和量

解析：呕血和黑便是上消化道出血的特征性表现，主要是由于出血的速度和出血量决定（A对）。如果出血量小，血液在胃内未引起恶心、呕吐，则血液通常从肠道排出。反之，如果出血很急、量多，幽门以下的血液反流到胃，也可引呕吐。